出现在胚胎第12周，迅速形成一个锥形软骨团，占据发育中升支的大部分的是
A. 髁突软骨
B. 喙突软骨
C. 下颌软骨
D. 上颌软骨
E. 侧舌隆突

正确答案：A。髁突软骨

解析：髁突软骨出现在胚胎第12周，迅速形成一个锥形（或胡萝卜形）软骨团，占据发育中升支的大部分。掌握“唾液腺与颌骨的发育”知识点。